在全球致死的寄生虫病中，下列哪种排第一位
A. 疟疾
B. 血吸虫病
C. 阿米巴虫病
D. 黑热病
E. 囊尾蚴病

正确答案：A。疟疾

解析：在全球致死的寄生虫病中，疟疾（A对）排第一位，其次为血吸虫病（B错）和阿米巴病（C错），黑热病（D错）、囊尾蚴病（E错）较少见。